清肺排毒汤是国家卫生健康委和国家中医药管理局针对新型冠状病毒感染性肺炎推出的中药复方。全方由麻黄、苦杏仁、生石膏先煎、桂枝、泽泻、猪苓、白术、茯苓、柴胡、黄芩、姜半夏、生姜、紫菀、款冬花、射干、细辛、山药、枳实、陈皮、藿香、炙甘草等组成。中医药专家认为COVID-19属于中医学的“寒湿疫”，基本病机是疫毒湿寒与伏燥搏结壅塞肺胸损伤正气导致气机痹阻升降失常元气虚衰。方中善清肺胃之火的生石膏与黄芩同为反佐药其性能特点是
A. 辛甘寒，主清泄，兼透解
B. 辛甘凉，主清泄，兼收敛
C. 辛甘大寒，主清泄，兼透解
D. 辛甘寒，主收敛，兼清泄
E. 辛甘微寒，主清泄，兼透解

正确答案：C。辛甘大寒，主清泄，兼透解

解析：本题考查的是石膏的性能特点。方中善清肺胃之火的生石膏与黄芩同为反佐药其性能特点是辛甘大寒，主清泄，兼透解（C对）。石膏：【性能特点】本品生用辛甘大寒，主清泄，兼透解，入肺、胃经，既善清泄气分实热和肺胃实火，又兼能解肌透热，热去则烦除、津生、渴止，为治气分高热和肺胃实火之要药。煅后涩凉，主收敛，兼清泄，外用能收敛生肌，兼清热，为治疮疡湿疹所常用。